结构类型为倍半萜大环内酯生物碱的化学成分是
A. 雷公藤碱
B. 汉防己甲素
C. 阿托品
D. 氧化苦参碱
E. 士的宁

正确答案：A。雷公藤碱

解析：本题考查的是生物碱的分类。结构类型为倍半萜大环内酯生物碱的化学成分是雷公藤碱（A对）。雷公藤中主要化学成分为雷公藤甲素、雷公藤乙素和雷公藤红素等。雷公藤中生物碱的基本结构主要分为两类：倍半萜大环内酯生物碱和精眯类生物碱。倍半萜大环内酯生物碱类主要为雷公藤碱、雷公藤次碱、雷公藤宁碱、雷公藤春碱和雷公藤碱己等。精眯类生物碱主要为苯乙烯南蛇碱、呋喃南蛇碱、苯代南蛇碱、南蛇藤别肉桂酰胺碱。生物碱的种类繁多，结构复杂，主要要求掌握以下五种基本母核类型生物碱的结构特征。1.吡啶类生物碱，此类生物碱多来源于赖氨酸，是由吡啶或哌啶衍生的生物碱，其结构简单，数量较少，主要有两种类型。（1）简单吡啶类：此类生物碱分子较小，结构简单，很多呈液态。如槟榔中的槟榔碱、槟榔次碱，烟草中的烟碱，胡椒中的胡椒碱等。（2）双稠哌啶类：由两个哌啶环共用一个氮原子稠合而成的杂环，具喹喏里西啶的基本母核。主要分布于豆科、石松科和千屈菜科。如苦参中的苦参碱、氧化苦参碱（D错），野决明中的金雀花碱等。2.莨菪烷类生物碱，此类生物碱多来源于鸟氨酸，由莨菪烷环系的C₃-醇羟基与有机酸缩合成酯。主要存在于茄科的颠茄属、曼陀罗属、莨菪属和天仙子属。重要化合物有莨菪碱（阿托品（C错））、古柯碱等。3.异喹啉类生物碱，这类生物碱来源于苯丙氨酸和酪氨酸系，具有异喹啉或四氢异喹啉的基本母核，在植物中分布广泛，数目较多，具有多方面的生物活性。根据其基本结构又分为多种类型，主要类型如下。（1）简单异喹啉类：如鹿尾草中的降血压成分萨苏林，是四氢异喹啉的衍生物。（2）苄基异喹啉类：又分为1-苄基异喹啉类和双苄基异喹啉类。①1-苄基异喹啉类：为异喹啉母核1位连有苄基的一类生物碱。如罂粟中具解痉作用的罂粟碱，乌头中的强心成分去甲乌药碱，厚朴中的厚朴碱等。②双苄基异喹啉类：为两个苄基异喹啉通过1～3个醚键相连接的一类生物碱。如存在于防己科北豆根中的主要酚性生物碱蝙蝠葛碱，汉防己中的汉防己甲素（B错）和乙素，十大功劳中的异汉防己甲素。（3）原小檗碱类：可以看成由两个异喹啉环稠合而成。依据两者结构母核中D环氧化程度不同，又分为小檗碱类和原小檗碱类。前者多为季胺碱，如黄连、黄柏、三颗针中的小檗碱；后者多为叔胺碱，如延胡索中的延胡索乙素。（4）吗啡烷类：具有部分饱和的菲核，如罂粟中的吗啡、可待因，青风藤中的青风藤碱等。4.吲哚类生物碱，这类生物碱来源于色氨酸，其数目较多，结构复杂，多具有显著的生物活性。主要分布于马钱科、夹竹桃科、茜草科等。吲哚类生物碱主要由色氨酸衍生而成，根据其结构特点，主要分为以下四类。（1）简单吲哚类：如板蓝根、大青叶中的大青素B，蓼蓝中的靛苷等。（2）色胺吲哚类：含有色胺部分，结构较简单。如吴茱萸中的吴茱萸碱。（3）单萜吲哚类：结构较复杂，如萝芙木中的利血平、番木鳖中的士的宁（E错）等。（4）双吲哚类：是由两分子单吲哚类生物碱聚合而成的衍生物，如长春花中具有抗癌作用的长春碱和长春新碱。5.有机胺类生物碱，结构特点是氮原子不在环状结构内，如麻黄中的麻黄碱，秋水仙中的秋水仙碱，益母草中的益母草碱等。